危险度特征分析时，对无阈值化学物主要计算出
A. 人群终生患癌超额危险度
B. 人群终生超额危险度
C. 人群年超额危险度
D. 人群年超额病例数
E. 人群患癌超额危险度

正确答案：A。人群终生患癌超额危险度

解析：本题考查危险度特征分析的相关内容。危险度特征分析时，对无阈值化学物主要计算出：①人群终生患癌超额危险度（A对BCDE错）；②人均患癌年超额危险度；③人群超额患癌病例数。